多种辅酶的组成成分中均含有不同的B族维生素，例如构成NAD+的维生素是
A. 磷酸吡哆醛
B. 核黄素
C. 叶酸
D. 尼克酰胺
E. 硫胺素

正确答案：D。尼克酰胺

解析：多种辅酶的组成成分中均含有不同的B族维生素，例如构成NAD+的维生素是烟酰胺尼克酰胺。掌握“辅酶与酶促反应”知识点。